前牙舌支托凹位于
A. 切角
B. 切缘
C. 舌侧颈1/3处
D. 舌侧中1/3处
E. 舌侧颈1/3与中1/3交界处

正确答案：E。舌侧颈1/3与中1/3交界处

解析：本题考查前牙支托凹的预备。前牙舌支托凹位于舌侧颈1/3与中1/3交界处（E对）。舌支托设置在前牙舌隆突上，多用于上下颌尖牙。舌支托凹可在基牙上直接预备成形，即以舌隆突高点为中心，在基牙舌侧的颈1/3与中1/3交界处，预备出一个稍圆钝的V字形沟，V形的顶点指向切端。完成的支托呈环状或钩状套在舌隆突上，保证义齿在受力后始终与基牙形成一个整体，不会推基牙向前。